治疗经前期综合征肝郁气滞，应首选的方剂是
A. 逍遥散
B. 柴胡疏肝散
C. 血府逐瘀汤
D. 滋水清肝饮
E. 丹栀逍遥散

正确答案：B。柴胡疏肝散

解析：治疗经前期综合征肝郁气滞，应疏肝解郁，养血调经，首选柴胡疏肝散（B对）。逍遥散（A错）可用于产后的肝郁气结证。血府逐瘀汤（C错）可用于气滞血瘀所导致的痛经、经闭、崩漏、癥瘕等。滋水清肝饮（D错）用于治疗阴虚所致的肝郁，胸胁胀满等。丹栀逍遥散（E错）可用于肝郁化火，热扰冲任导致的月经不调、崩漏、胎漏等。